肾阴不足，心火偏亢，以致心肾不交，其治疗宜釆用
A. 益火补土法
B. 金水相生法
C. 抑木扶土法
D. 培土制水法
E. 泻火补水法

正确答案：E。泻火补水法

解析：泻火补水法，又称泻南补北法、滋阴降火法。是通过泻心火补肾水以治疗心肾不交的治法。适用于肾阴不足，心火偏旺，水火未济，心肾不交之证（E对）。益火补土法（A错）主要用于肾阳衰微不能温运而致脾阳不振的脾肾阳虚证。金水相生法（B错）主要用于治疗肺阴亏虚，不能滋养肾阴，或肾阴亏虚，不能滋养肺阴的肺肾阴虚证。抑木扶土法（C错）治疗肝脾不和或肝气犯胃病证。培土制水法（D错）治疗脾虚水泛、水湿停聚病证。